侵犯人体可引起关节疼痛重着症状的邪气是
A. 暑邪
B. 热邪
C. 湿邪
D. 寒邪
E. 燥邪

正确答案：C。湿邪

解析：患者关节疼痛重着，是由于湿邪外袭肌表，困遏清阳，清阳不升，则头重如束裹，湿邪阻滞经络关节，阳气不得布达，则可见肌肤不仁、关节疼痛重着（C对）。暑为阳邪，其性炎热，升散，易扰心神，伤津耗气，且多挟湿（A错）。火热为阳邪，其性炎上，易扰心神，易伤津耗气，易生风动血，易致疮痈（B错）。寒为阴邪，易伤阳气，其性凝滞主痛，寒性收引（D错）。